下述哪个关节含关节盘
A. 肩关节
B. 髋关节
C. 踝关节
D. 腕关节
E. 肘关节

正确答案：D。腕关节

解析：肩关节（A错）由肱骨头与肩胛骨关节盂构成；髋关节（B错）由髋臼与股骨头构成；踝关节（C错）由胫、腓骨的下端与跖骨滑车构成； 肘关节（E错）是由肱骨下端与尺骨和桡骨上端构成的复关节均不含关节盘，关节盘存在于颞下颌关节、胸锁关节、腕关节（D对）和膝关节等处。